后牙Ⅱ类洞型鸠尾峡的部位位于
A. 洞底轴髓线角靠近中线处
B. 洞底轴髓线角处
C. 洞底轴髓线角靠近边缘嵴处
D. 根据龋坏情况酌情处理
E. 颊舌牙尖的任何部位

正确答案：A。洞底轴髓线角靠近中线处

解析：本题考查窝洞的固位形-鸠尾固位。后牙Ⅱ类洞型鸠尾峡应在轴髓线角的内侧，即在轴髓线角的靠近中线侧（A对）。鸠尾峡位于洞底轴髓线角处时会使轴髓线角处出现应力集中，剩余牙体组织容易崩裂（B错）。鸠尾峡位于洞底轴髓线角靠近边缘嵴处，会使鸠尾峡部出现无基釉质，降低了剩余牙体组织的抗力作用（C错）。根据龋坏情况酌情处理，如果龋坏范围较小，（牙合）面洞形较小，仍应当使鸠尾峡位于洞底轴髓线角的内侧，不可以随意定位（D错）。鸠尾峡位于颊舌牙尖之间，但有一定宽度的长度要求限制，不可能位于任何部位（E错）。